男性，45岁，右下腹隐痛4个月，近3个月来乏力，消瘦，常有低热，查体：结膜苍白，右侧腹部可触及一5×3cm肿块，化验，血红蛋白95g/l，若检查诊断为升结肠癌
A. 升结肠切除术
B. 右半结肠切除术
C. 全结肠切除术
D. 升结肠及部分横结肠切除术
E. 升结肠及末段回肠切除术

正确答案：B。右半结肠切除术

解析：45岁男性患者，右下腹隐痛4个月，检查诊断为升结肠癌，治疗原则是以手术切除为主的综合治疗，最佳手术方式为右半结肠切除术（B对），切除范围包括右半横结肠以近及回肠末段和相应系膜、胃第6组淋巴结，回肠与横结肠端端或端侧吻合。结肠癌根治性手术的常见术式包括右半结肠切除术、横结肠切除术、左半结肠切除术和乙状结肠切除术。